平滑面龋暗层孔隙所占容积
A. 0.01
B. 0.05
C. 2～4%
D. 5%～25%
E. 10%～30%

正确答案：C。2～4%

解析：暗层：紧接于透明层表面，当磨片浸渍于树胶或喹啉时，此层表现为暗黑色。暗层较透明层孔隙增加，孔隙容积约为2%～4%。掌握“牙釉质龋”知识点。